继发性肝癌一般不会发生变化的指标是
A. 碱性磷酸酶
B. 谷氨酸氨基转移酶
C. 甲胎蛋白
D. 白蛋白
E. 丙氨酸氨基转移酶

正确答案：C。甲胎蛋白

解析：继发性肝癌一般不会发生变化的指标是甲胎蛋白（C对）。